基底细胞腺瘤临床特点为
A. 生长缓慢的剧痛性肿块
B. 生长缓慢的无痛性脓肿
C. 生长缓慢的无痛性肿块
D. 快速生长的无痛性肿块
E. 快速生长的剧痛性肿块

正确答案：C。生长缓慢的无痛性肿块

解析：基底细胞腺瘤多数肿瘤为实性，界限清楚，活动，表面呈结节状，常有局部囊性感。临床表现为生长缓慢的无痛性肿块。掌握“基底细胞腺瘤及恶性多形性腺瘤”知识点。